腹股沟淋巴结不接收下列哪项淋巴回流
A. 足外测
B. 小腿前内侧
C. 肛门
D. 外阴部
E. 直肠上段

正确答案：E。直肠上段

解析：直肠上段（E错，为本题正确答案）的淋巴注入直肠上淋巴结、髂内淋巴结、骶淋巴结，不注入腹股沟淋巴结。